下列各项，不会出现虚里动高的是
A. 热证
B. 剧烈运动后
C. 心气衰竭
D. 宗气内虚
E. 宗气外泄

正确答案：D。宗气内虚

解析：宗气内虚，常见虚里按之其动微弱（D对）。虚里动高，聚而不散者为热证（A错）。剧烈运动后虚里动高，片刻之后即能平复如常，不属病态（B错）。虚里搏动散漫而数，伴胸高者多为心力衰竭（C错）。宗气外泄，常见虚里按之动而应衣（E错）。